女，45岁。急性白血病接受化疗过程中诉食欲差，疲乏无力，时有恶心。查体：T37℃，P90次/分，R18次/分，BP110/70mmHg。血常规：Hb90g/L，RBC3.1×10¹²/L，WBC5.6×10⁹/L，Plt65×10⁹/L。患者要求输血，此时正确的处理措施是
A. 输注机采血小板1个治疗量
B. 不予输血并向患者说明理由
C. 输注血浆220ml
D. 输注全血1单位
E. 输注悬浮红细胞1单位

正确答案：B。不予输血并向患者说明理由

解析：中年女性患者，急性白血病接受化疗过程中诉食欲差，疲乏无力。查体：T37℃（正常值36℃～37.3℃），P90次/分（正常60～100次/分），R18次/分（正常值12～20次/分），BP110/70mmHg（正常值100～120/60～80mmHg）。血常规：Hb90g/L（女性正常值110g/L～150g/L，提示轻度贫血），RBC3.1×10¹²/L（正常3.5～5.0×10¹²/L），WBC5.6×10⁹/L（4.0～10×10⁹），Plt65×10⁹/L（100～300×10⁹/L）。根据病史、查体和血常规结果，该患者目前只有轻度贫血，血压也在正常值范围。此外，根据2000年卫生部输血指南建议：Hb＞100g/L不需要输血。Hb为70～100g/L时，应根据病人的具体情况来决定是否输血。对于可输可不输的病人应尽量不输。因此该患者此时应暂不输血（B对）。输注机采血小板（A错）适用于血小板严重减少的情况。输注血浆（C错）主要适用于各种凝血因子缺乏症。输注全血（D错）适用于失血量超过30%的情况，且由于全血中成分较多，易发生输血反应，现临床上已很少输注全血。输注悬浮红细胞（E错）适用于急性失血和慢性失血者。